治疗小儿暑邪感冒首选
A. 荆防败毒散
B. 桑菊饮
C. 银翘散
D. 三拗汤
E. 新加香薷饮

正确答案：E。新加香薷饮

解析：小儿暑邪感冒首选清暑解表新加香薷饮加减（E对）。荆防败毒散用于风寒感冒（A错）。桑菊饮用于风热感冒（B错）。银翘散用于风热感冒（C错）。三拗汤用于感冒夹痰（D错）。